病因模型的主要用途不包括
A. 阐述病因之间的关系
B. 阐述病因与疾病的关系
C. 指示病因的方向，以揭示新的病因
D. 是流行病学研究设计的理论基础
E. 解释流行病学概念和原理

正确答案：D。是流行病学研究设计的理论基础

解析：本题考查病因模型的主要用途。病因模型的主要用途包括：①用于阐述病因之间的关系（A对）以及病因与疾病的关系（B对）；②指示病因的方向以揭示新的病因（C对）；③用于说明病因的作用和解释流行病学概念和原理（E对）。是流行病学研究设计的理论基础（D错，为本题正确答案）不是病因模型的主要用途。